有关乳糜池的描述，正确的是
A. 由左、右腰干和肠干合成
B. 合成位置一般在第三腰椎前面
C. 向上穿膈肌食管裂孔
D. 穿左膈脚入胸腔
E. 由肠干膨大形成

正确答案：A。由左、右腰干和肠干合成

解析：乳糜池由左右腰干和肠干（A对E错）在第一腰椎前合成（B错），向上穿膈肌主动脉裂孔进入胸腔（CD错）。